男，55岁。因急性阑尾炎穿孔入院。行阑尾切除术后第6天，出现发热，体温上升至39.0°C，伴有腹泻及里急后重。查体：心肺未见明显异常，手术切口无红肿、渗出。此时首选的检查是
A. 粪常规
B. 胸部X线片
C. 直肠指诊
D. 腹部X线片
E. 腹部B超

正确答案：C。直肠指诊

解析：老年男性患者，阑尾切除术后第6天，出现发热，体温上升至39.0℃（全身中毒症状），伴有腹泻及里急后重（盆腔脓肿临床表现）。要考虑阑尾治疗未及时导致的盆腔脓肿的的可能，因此首选的检查是直肠指诊（C对），可发现直肠前壁水肿增厚、隆起、波动感，有明显刺痛。脓肿应根据临床情况尽早尽快处理，盆腔脓肿可经肛门或引导穿刺引流，同时辅以抗生素液冲洗，坏死组织较多可加用组织溶解剂，当引流效果不佳或无条件穿刺时，应再次进行手术行脓肿引流。